某地多个村庄的村民，食用发霉粮食后，突发一过性发热、呕吐、厌食、黄疸、水肿，其原因为
A. 镰刀菌属中毒
B. 赤霉病麦中毒
C. 桔青霉素中毒
D. 黄曲霉毒素中毒
E. 展青霉素中毒

正确答案：D。黄曲霉毒素中毒

解析：本题考查黄曲霉毒素中毒。黄曲霉是我国粮食中常见的真菌，黄曲霉毒素中毒临床表现以黄疸为主，出现发热、呕吐和厌食，重者出现腹水、下肢水肿、肝脾大及肝硬化，甚至死亡。根据该地村民的症状，可判断其原因为黄曲霉毒素中毒（D对ABCE错）。